外科救治感染性休克时不正确的做法是
A. 应用抗菌药物
B. 补充血容量
C. 待休克好转后手术处理感染灶
D. 使用皮质激素
E. 采用血管扩张药物治疗

正确答案：C。待休克好转后手术处理感染灶

解析：本题考查感染性休克的治疗。外科救治感染性休克时不正确的做法是待休克好转后手术处理感染灶（C错，为本题的正确答案）。外科救治感染性休克时的治疗措施包括：1.补充血容量（B对）；2.控制感染：主要措施是应用抗菌药物（A对）和处理原发感染灶，原发感染病灶的存在是发生休克的主要原因，应尽早处理，才能纠正休克和巩固疗效；3.纠正酸中毒；4.心血管活性药物的应用：经补充血容量、纠正酸中毒而休克未见好转时，应采用血管扩张药物治疗（E对）；5.皮质激素治疗（D对）；6.其他治疗：包括营养支持，对并发的DIC、重要器官功能障碍的处理。